关于双手触诊法下述哪项叙述不正确
A. 将左手置于被检查脏器或包块的后部
B. 将被检查部位推向右手方向
C. 使被检查脏器或包块更接近于体表
D. 不利于右手触诊
E. 用于肝、脾、肾和腹腔肿物的检查

正确答案：D。不利于右手触诊

解析：触诊是医师通过手接触被检查部位时的感觉来进行判断的一种诊断方法，分为浅部触诊和深部触诊（深部滑行触诊和双手触诊）。双手触诊法是将左手掌置于被检查脏器或包块的背后部（A对），右手中间三指并拢平置于腹壁被检查部位，左手掌向右手方向托起（B对），使被检查的脏器或包块位于双手之间，并更接近体表（C对），除可以起到固定作用外，还有利于右手触诊检查（D错，为本题正确答案）。主要用于肝、脾、肾和腹腔肿物的检查（E对）。